以下哪项属于组成社会环境的因素
A. 生产关系
B. 阶级关系
C. 社会关系
D. 人际关系
E. 以上均包括

正确答案：E。以上均包括

解析：社会环境指人类在生产、生活和社会交往等活动过程中建立起来的上层建筑体系，它由各种非物质因素组成。包括生产关系、阶级关系与社会人际关系等。掌握“环境卫生与职业卫生”知识点。